主要用于治疗无痰干咳的药物是
A. 氯化铵
B. 氨溴索
C. 溴己胺
D. 右美沙芬
E. 氨茶碱

正确答案：D。右美沙芬

解析：本题考查右美沙芬。主要用于治疗无痰干咳的药物是右美沙芬（D对）。右美沙芬是合成的吗啡类衍生物，为非依赖性中枢性镇咳药。用于各种原因引起的干咳，包括上呼吸道感染（如感冒和咽炎）、支气管炎等呼吸系统疾病用药引起的咳嗽。氯化铵（A错）、氨溴索（B错）、溴己胺（C错）为祛痰药。氨茶碱（E错）为平喘药。